可摘局部义齿修复中适宜采用RPI卡环并使用近中（牙合）支托的情况是
A. KennedyⅠ、Ⅱ类牙列缺损，游离缺失侧基牙条件好，缺牙区牙槽嵴低平
B. KennedyⅠ、Ⅱ类牙列缺损，游离缺失侧基牙条件差，缺牙区牙槽嵴丰满
C. 口腔前庭较浅，基牙的观测线接近龈缘
D. KennedyⅣ类牙列缺损，基牙向远中倾斜
E. 以上都不是

正确答案：B。KennedyⅠ、Ⅱ类牙列缺损，游离缺失侧基牙条件差，缺牙区牙槽嵴丰满

解析：RPI卡环组用于游离端义齿时，由于其在保护近缺隙基牙的同时，有可能会增加缺牙区牙槽嵴的负担。掌握“局部义齿固位体”知识点。